可摘局部义齿钴铬合金铸造卡环固位臂进入倒凹的深度
A. 1mm
B. 0.75mm
C. 0.5mm
D. 2mm
E. 0.3mm

正确答案：E。0.3mm

解析：本题考查倒凹深度。可摘局部义齿钴铬合金铸造卡环固位臂进入倒凹的深度为0.3mm（E对）。基牙倒凹内牙面某一点至分析杆的垂直距离称为该点倒凹深度。常用水平倒凹深度约0.25mm、0.50mm和0.75mm的三种倒凹测量尺来标定基牙轴面的固位倒凹区。通常0.3mm倒凹深度适合钴铬合金等非贵金属合金的铸造卡环，0.5mm（C错）倒凹深度适合贵金属合金的卡环，0.75mm（B错）倒凹深度适合冷弯不锈钢钢丝卡环。